治疗亚急性感染性心内膜炎，首选的抗生素是
A. 庆大霉素
B. 青霉素
C. 红霉素
D. 链霉素
E. 阿米卡星

正确答案：B。青霉素

解析：亚急性感染性心内膜炎主要致病菌为草绿色链球菌。其对青霉素敏感，所以治疗时首选青霉素320万～400万U，静脉滴注，每4～6小时一次。掌握“自体瓣膜感染性心内膜炎”知识点。